肝癌是我国排名前五的恶性肿瘤之一，且各期的治疗效果一般都较差，患者1年生存率仅为32.03%。HBV病毒感染是肝癌的主要病因，我国约10%的成年人有HBV感染。有人建议在HBV人群中开展肝癌筛查（甲胎蛋白检测或超声诊断），你是否赞同，主要理由是
A. 赞同，肝癌是威胁我国人群健康的重要疾病
B. 赞同，肝癌的高危人群是HBV感染者
C. 不赞同，筛查出来的病例后续无有效的治疗方案
D. 不赞同，筛查方法灵敏度和特异度无法确定
E. 赞同，筛检的方法简单经济、创伤小

正确答案：C。不赞同，筛查出来的病例后续无有效的治疗方案

解析：本题考查筛检的实施原则。题干中已说肝癌各期的治疗效果一般都较差，且生存率低，所以不赞同在HBV人群中开展肝癌筛查，筛查出来的病例后续无有效的治疗方案（C对ABDE错）。